属于促胰岛素分泌剂的是
A. 阿卡波糖
B. 二甲双胍
C. 那格列奈
D. 艾塞那肽
E. 吡格列酮

正确答案：C。那格列奈

解析：本题考查促胰岛素分泌剂。那格列奈（C对）属于促胰岛素分泌剂。口服降糖药的分类：（1）磺酰脲类促胰岛素分泌药：格列本脲。（2）非磺酰脲类促胰岛分泌药：瑞格列奈。（3）双胍类药：二甲双胍。（4）α-葡萄糖苷酶抑制剂：阿卡波糖。（5）胰岛素增敏剂：吡格列酮。（6）胰高糖素样肽-1（GLP-1）受体激动剂：艾塞那肽。（7）二肽基肽酶-4（DPP-4）抑制剂：如西格列汀。